医学上主要用于空气灭菌的电磁辐射是
A. 紫外线
B. 红外线
C. γ射线
D. 可视线
E. 微波辐射

正确答案：A。紫外线

解析：医学上主要用于空气灭菌的电磁辐射是紫外线（A对）。其主要作用为干扰DNA的复制与转录，导致细菌的变异及死亡，从而达到灭菌的效果。（八版医学微生物学P34）紫外线可被普通玻璃、纸张、尘埃、水蒸气等阻挡，故一般用于手术室、传染病房、无菌实验室的空气消毒。红外线（B错）多用于医疗器械和食具的消毒与灭菌。γ射线（C错）常用于一次性医用塑料制用品、食品、药品和生物制品的消毒。可见光（D错）为人眼所能见到的光，杀菌能力较弱。微波辐射（E错）主要用于食品、非金属器械等消毒。